作用机制涉及NO生成与释放的药物包括
A. 普罗布考
B. 硝酸甘油
C. 硝普钠
D. 缬沙坦
E. 辛伐他汀

正确答案：B、C。硝酸甘油；硝普钠

解析：本题考查药物的作用机制。硝酸甘油（B对）主要通过上调NO/cGMP通路而舒张血管平滑肌。硝普钠（C对）属硝基扩血管药，作用机制与硝酸酯类相似，通过释放NO，激活鸟苷酸环化酶，增加血管平滑肌细胞内cGMP水平而起作用。普罗布考（A错）通过渗入LDL颗粒核心中，影响脂蛋白代谢，使LDL易通过非受体途径被清除，主要用于高胆固醇血症，尤其是纯合子型家族性高胆固醇血症 及黄色瘤患者。缬沙坦（D错）为血管紧张素Ⅱ受体阻断药。辛伐他汀（E错）为调血脂药，他汀类药物的结构与HMG-CoA相似，与HMG-CoA还原酶的亲和力比HMG-CoA高数千倍，对该酶发生竞争性抑制使胆固醇合成受阻。